药师在审核处方时，无需要求确认或重新开处方的情形是
A. 诊断为麻疹，使用阿莫西林抗感染治疗
B. 将酚麻美敏胶囊和板蓝根颗粒开在同一张处方上
C. 给糖尿病患者同时开具消渴丸和格列本脲
D. 头孢曲松钠选用复方氯化钠注射液作溶媒
E. 低分子肝素的给药方法为静脉滴注

正确答案：B。将酚麻美敏胶囊和板蓝根颗粒开在同一张处方上

解析：本题考查处方的审核。药师在审核处方时，无需要求确认或重新开处方的情形是将酚麻美敏胶囊和板蓝根颗粒开在同一张处方上（B对）。阿莫西林抗感染治疗属于无适应证用药，属于超常处方，需药师找到开具处方的医师确认或重新开处方（A错）。消渴丸中含有格列本脲，属于重复用药，应当判定为用药不适宜处方（C错）。头孢曲松钠选用复方氯化钠注射液作溶媒会有微粒形成，属于有配伍禁忌，应当判定为用药不适宜处方（D错）。低分子肝素的给药方法为皮下注射（E错）。